可以导致胎儿颅骨和面部畸形的药品是
A. 特布他林
B. 甲氨蝶呤
C. 依托红霉素
D. 骨化三醇
E. 葡萄糖酸钙

正确答案：B。甲氨蝶呤

解析：本题考查妊娠期用药。妊娠期药物的致畸作用与器官形成的顺序有关：妊娠3～5周，中枢神经系统、心脏、肠、骨骼及肌肉等均处于分化期，致畸药物在此期间可影响上述器官或系统；如沙利度胺可引起胎儿肢体、耳、内脏畸形，雌孕激素、雄激素可引起胎儿性发育异常，叶酸拮抗剂（甲氨蝶呤）（B对）可导致颅面部畸形、腭裂等；烷化剂如氮芥类药物可引起泌尿生殖系统异常，指趾畸形。